男孩，1岁。发热3天，呕吐1次，抽搐1次，既往6个月曾热性惊厥1次。按时预防结种，出生史无特殊。查体：T38.2℃，R30次/分，BP90/55mmHg，颈抵抗（＋），双肺听诊未见异常。心率130次/分，律齐，腹软，肝脾肋下未触及，四肢暧，肌力、肌张力正常。Babinski征（+）。为明确诊断，首先最宜进行的检查是
A. 脑电图
B. 血钙、磷测定
C. 腰穿检查脑脊液
D. 粪镜检及培养
E. 血培养加药物敏感实验

正确答案：C。腰穿检查脑脊液

解析：男性幼儿患者，发热3天，呕吐1次，抽搐1次，既往6个月曾热性惊厥1次，颈抵抗（＋），Babinski征（+）。患者有惊厥、颅内压增高表现，综合患者的症状、体征和辅助检查，初步诊断为中枢神经系统感染。为明确诊断，首先最宜进行的检查是腰穿检查脑脊液（C对）。脑电图（A错）适用于癫痫与精神性疾病。血钙、磷测定适用于手足搐搦症（B错）。粪镜检及培养适用于中毒型细菌性痢疾（D错）。血培养加药物敏感实验（E错）虽适用于中枢神经系统感染，但不作为首选。